以下何者不是维持肾正常位置的结构
A. 肾被膜
B. 肾的血管
C. 肾的毗邻器官
D. 脏腹膜
E. 无

正确答案：D。脏腹膜

解析：肾的固定因素有肾被膜（A对）、肾血管（B对）、毗邻器官（C对）、腹内压以及壁腹膜等，而非脏腹膜（D错，为本题正确答案）。